有关抗躁狂药碳酸锂的叙述，哪项是错误的
A. 增加钠盐摄入可促进其排泄
B. 对正常人精神活动几无影响
C. 促进脑内去甲肾上腺素及多巴胺的释放
D. 中毒时主要表现为中枢神经系统症状
E. 用药期间应每日测定血锂浓度

正确答案：C。促进脑内去甲肾上腺素及多巴胺的释放